“江山易改，禀性难移”说明人格具有
A. 整体性
B. 独特性
C. 功能性
D. 稳定性
E. 独立性

正确答案：D。稳定性

解析：人格心理特征形成之后就具有相对稳定性。掌握“人格”知识点。